关于药物动力学中房室模型的说法，正确的是
A. 一个房室代表机体内一个特定的解剖部位（组织脏器）
B. 单室模型是指进入体循环的药物能很快在血液与各部位之间达到动态平衡
C. 药物在同一房室不同部位与血液建立动态平衡的速率完全相等
D. 给药后同一房室中各部位的药物浓度和变化速率均相等
E. 双室模型包括分布速率较慢的中央室和分布较快的周边室

正确答案：B。单室模型是指进入体循环的药物能很快在血液与各部位之间达到动态平衡

解析：本题考查房室模型。单室模型是指进入体循环的药物能很快在血液与各部位之间达到动态平衡（B对），并通过排泄或代谢进行消除；房室模型仅是进行药动学分析的一种抽象概念，并不一定代表某一特定解剖部位（组织脏器）（A错）；药物在同一房室不同部位与血液建立动态平衡的速率不完全相等（C错）；给药后同一房室中各部位的药物浓度变化速率相近而不是相等（D错）；双室模型中迅速（E错）和血液浓度达到平衡的部位被归为中央室，随后达到平衡的部位则归并为周边室。